根据常见病辨证论治的理论，时行感冒的治法是
A. 辛温解表
B. 辛凉解表
C. 清热解毒
D. 益气解表
E. 清热凉血

正确答案：C、E。清热解毒；清热凉血

解析：本题考查的是感冒的辨证论治。根据常见病辨证论治的理论，时行感冒的治法是清热解毒凉血（CE对）。感冒是感受风邪或时行病毒，卫表失和而导致的常见外感疾病，临床表现以鼻塞、流涕、喷嚏、头痛、恶寒、发热、全身不适、脉浮等为特征。（一）风寒感冒：【治法】辛温解表（A错），宣肺散寒。（二）风热感冒：【治法】辛凉解表（B错），宣肺清热。（三）时行感冒：【治法】清热解毒，凉血泻火。（四）气虚感冒：【治法】益气解表（D错）。